认为生姜为“呕家圣药”的医家是
A. 张仲景
B. 孙思邈
C. 刘完素
D. 朱丹溪
E. 龚廷贤

正确答案：B。孙思邈

解析：张仲景在《金匮要略》中制定了治疗呕吐行之有效的方剂，如小半夏汤，大半夏汤，生姜半夏汤等（A错）。孙思邈在《备急千金要方·呕吐哕逆》篇中指出：“凡呕者，多食生姜，此是呕家圣药”（B对）。刘完素在《素问玄机原病式·热类·喘呕》中指出：“凡呕吐者，火性上炎也，无问表里，通宜凉膈散”（C错）。朱丹溪在《丹溪心法·呕吐》中指出：“胃中有热，膈上有痰者，二陈汤加炒山栀、黄连、生姜。有久病呕者，胃虚不纳谷也，用人参、生姜、黄芪、白术、香附之类。大抵呕吐以半夏、橘皮、生姜为主”（D错）。龚延贤在《寿世保元·呕吐》中对外感寒邪、胃热、胃寒、呕哕痰涎、水寒停胃、久病胃虚等不同病因所致的呕吐选用了不同的方药（E错）。